男，20岁，坚持认为自己的父亲已经被人害死了，而那个朝夕陪伴自己的父亲只是看起来像父亲的一个人冒充的，家人劝说也不改变他的看法。最适宜的治疗药物是
A. 银杏叶片
B. 利培酮
C. 丙戊酸钠
D. 碳酸锂
E. 帕罗西汀

正确答案：B。利培酮

解析：患者妄想内容与事实不符，缺乏客观现实基础，但患者仍坚信不移，最可能的症状是妄想。临床可选用奥氮平、氨磺必利以及利培酮（B对）。银杏叶片（A错）多用于改善抗精神病药物引起的迟发性运动障碍（P272）。碳酸锂（D错）、丙戊酸钠（C错）属于心境稳定剂，临床用于治疗双相障碍发作。帕罗西汀（E错）属于抗抑郁药，临床用于治疗抑郁发作。